T细胞不具有的受体是
A. E受体
B. 抗原受体
C. 丝裂原受体
D. CKR
E. IgG Fc受体

正确答案：E。IgG Fc受体